某男，54岁。1年前，爪甲菲薄发软，影响工作。虽多方求治但收效不大。刻下面黄，夜寐多梦，时有头晕心慌，纳食与二便正常；舌淡红苔薄白脉细沉。血红蛋白偏低。医师诊为肝血不足、筋爪失养治养血补肝益筋。药用熟地黄12g、山茱萸10g、当归10g、炒白芍10g、五味子5g打碎、阿胶珠10g、炒酸枣仁15g打碎、川芎5g、木瓜10g、生牡蛎30g打碎先煎、夜交藤15g。10剂每日1剂水煎分2次服。以此方加减治疗数月爪甲复常。1年后患者又来就诊，因工作劳累，又见心悸怔忡、失眠健忘、食少倦怠、面黄。医师处以人参归脾丸，因其除能益气补血外，又能
A. 滋肾养肝
B. 平肝安神
C. 益肾宁心
D. 健脾宁心
E. 滋阴安神

正确答案：D。健脾宁心

解析：本题考查的是人参归脾丸的功能。因工作劳累，又见心悸怔忡、失眠健忘、食少倦怠、面黄。医师处以人参归脾丸，因其除能益气补血外，又能健脾宁心（D对）。人参归脾丸：【功能】益气补血，健脾宁心。杞菊地黄丸：【功能】滋肾养肝（A错）。天麻钩藤颗粒：【功能】平肝息风，清热安神（B错）。天王补心丸：【功能】滋阴养血，补心安神（E错）。功能为益肾宁心（C错）的中成药，2022年考试指南未明确说明。